根据医疗器械分类管理规定，下列属于二类医疗器械的是
A. 体温计、皮肤缝合钉、无菌医用手套
B. 超声三维系统软件、血压计、核磁共振成像设备
C. 针灸针、听诊器、医用防护服
D. 集液袋、手术刀、睡眠监护系统软件

正确答案：A。体温计、皮肤缝合钉、无菌医用手套

解析：本题考查医疗器械的分类。根据医疗器械分类管理规定，下列属于二类医疗器械的是体温计、皮肤缝合钉、无菌医用手套（A对）。第一类是风险程度低，实行常规管理可以保证其安全、有效的医疗器械。如外科用手术器械（刀、剪、钳、镊夹、针、钩）、听诊器（无电能）（C错）、反光镜、反光灯、医用放大镜、（中医用）刮痧板、橡皮膏、透气胶带、手术衣、手术帽、检查手套、集液袋（D错）等。第二类是具有中度风险，需要严格控制管理以保证其安全、有效的医疗器械。如血压计、体温计、心电图机、脑电图机、手术显微镜、（中医用）针灸针、助听器、皮肤缝合钉、避孕套、避孕帽、无菌医用手套、睡眠监护系统软件、超声三维系统软件、脉象仪软件等。第三类是具有较高风险，需要采取特别措施严格控制管理以保证其安全、有效的医疗器械。如心脏起搏器、体外反搏装置、血管内窥镜、超声肿瘤聚焦刀、高频电刀、微波手术刀、医用磁共振成像设备（B错）、钻60治疗机、正电子发射断层扫描装置（PECT）、植入器材、植入式人工器官、血管支架、血管内导管、一次性使用输液器、输血器等。